早期矽肺患者，肺功能改变程度与X线胸片表现严重程度
A. 一定一致
B. 不一定一致
C. 前者重于后者
D. 后者重于前者
E. 两者毫无关系

正确答案：B。不一定一致

解析：本题考查的是肺功能与矽肺进程的关系。早期发病时，机体代偿能能力较强，临床检查上有时会存在无法查出早期病症的状况。矽肺患者的肺功能改变程度与X线胸片表现严重程度不一定是一致的（B对ACDE错）。